邪正盛衰决定着
A. 病证的寒热
B. 病位的表里
C. 气血的盛衰
D. 病证的虚实
E. 以上都不是

正确答案：D。病证的虚实

解析：邪气盛则实，精气夺则虚，邪正双方不断斗争的态势和结果，不仅关系着疾病的发生，而且直接影响着疾病的发展和转归，同时也决定病证的虚实变化（D对）。寒热主要取决于阴阳平衡的关系（A错）。邪正盛衰对病位表里、体内气血有一定影响，但不完全由他决定（BCE错）。